男性，58岁，进餐后突发性上腹刀割样剧痛2小时。全腹压痛，板状腹，肝浊音界及肠鸣音消失。X线显示膈下新月形游离气体。既往有胃溃疡史25年。下列治疗中，最佳的手术方式是
A. 胃大部切除术
B. 大网膜覆盖穿孔缝合术
C. 迷走神经切断加胃窦切除术
D. 高选择性迷走神经切断术
E. 缝合穿孔后行迷走神经切断加胃空肠吻合术

正确答案：A。胃大部切除术

解析：中年男性患者，有胃溃疡病史，突发上腹部剧痛，全腹压痛、板状腹（腹膜刺激征，提示急性腹膜炎），肝浊音界消失，膈下游离新月影（提示为胃肠穿孔），结合患者病史、体查和影像学检查，应考虑为急性胃溃疡穿孔。急性胃溃疡穿孔最佳的手术方式是胃大部切除术（A对），因为该术式可一次性解决穿孔和溃疡两个问题。溃疡穿孔缝合术（如大网膜覆盖修补术）（B错）适用于穿孔时间超过8小时、腹腔污染严重及不能耐受手术的患者，且术后仍需正规的抗溃疡药物治疗。迷走神经切断术（CDE错）主要用于治疗十二指肠溃疡，十二指肠溃疡的发生与胃酸分泌增高密切相关，迷走神经切断术可阻断迷走神经对壁细胞的刺激，消除神经性胃酸分泌；消除迷走神经引起的胃泌素分泌，减少体液性胃酸分泌。